腹痛的基本病机是
A. 肝脾不和，胃气郁滞
B. 肝气郁结，胃失和降
C. 肝脾湿热，络脉不和
D. 脏腑失和，气血不畅
E. 脾胃失和，瘀血阻滞

正确答案：D。脏腑失和，气血不畅

解析：腹痛的发生，其病理因素主要有寒凝、火郁、食积、气滞、血瘀，病理性质不外寒热虚实四端，其病机不离“不通则痛，不荣则痛”。各病因直接多相互联系，或相兼为病，如寒邪客久，郁而化热可致郁热内结，气滞作痛，血行不畅，可成瘀血内阻，也可寒热并见，虚实夹杂，气滞血瘀。外感寒热，内伤饮食、情志，以及虫积、跌仆等原因，皆可导致脏腑气机不利，气血运行不畅，经脉流行阻滞而出现实痛，气血不足，阳气虚弱，使脏腑经脉失于温养，气血运行无力而成虚痛。因此腹痛总的病因病机为脏腑失和，气血运行不畅（D对）。